下列根除幽门螺杆菌的方案中首选的是
A. 质子泵抑制剂+克拉霉素+铋剂，治疗2周
B. H2受体拮抗剂+阿莫西林+甲硝唑，治疗1周
C. 质子泵抑制剂+克拉霉素+铋剂+阿莫西林，治疗10天
D. 铋剂+克拉霉素+法莫替丁，治疗10天
E. 质子泵抑制剂+克拉霉素+阿莫西林+硫糖铝，治疗1个月

正确答案：C。质子泵抑制剂+克拉霉素+铋剂+阿莫西林，治疗10天

解析：根除幽门螺杆菌首选三联疗法（1种质子泵抑制剂+2种抗生素或1种铋剂+2种抗生素）或四联疗法（1种质子泵抑制剂+1种铋剂+2种抗生素）（C对），疗程7～14天。根除幽门螺杆菌至少应用两种抗生素（AD错）。H₂受体拮抗剂效果次于质子泵抑制剂，三联疗法中不能用H₂受体拮抗剂替代质子泵抑制剂（B错）。硫糖铝为弱碱性抗酸剂，不用于根除幽门螺杆菌的治疗（E错）。